男，35岁。因胃癌入院手术，输注红细胞2单位，新鲜冰冻血浆。在输血后4小时，患者突然气急，呼吸困难，迅速出现呼吸衰竭，T37℃，P98次/分，R28次/分，BP120/70mmHg。该患者出现的最可能的是
A. 循环超负荷
B. 细菌性反应
C. 急性溶血反应
D. 过敏反应
E. 输血相关急性肺损伤

正确答案：E。输血相关急性肺损伤

解析：输血相关的急性肺损伤是因为供血者血浆中存在白细胞凝集素或HLA（人类白细胞抗原）特异性抗体所致，一般在输血后1～6小时后发生，主要症状为呼吸困难、肺水肿及低氧血症，与患者症状相符（E对）。循环超负荷（A错）是由输血过量或过快导致的，常见于心功能低下、老年、幼儿及低蛋白血症病人，表现为突发的心率加快、呼吸急促、发绀或血性泡沫痰。该患者输注血量较少，一般不会引起循环超负荷。细菌性反应（B错）表现为寒战高热、脓血症等。急性溶血反应（C错）在输注十几毫升血型不合的血后即可出现，表现为寒战、高热、腰背酸痛、血红蛋白尿等。过敏反应（D错）多发生在输血数分钟后，也可在输血中或输血后发生，表现为全身瘙痒、荨麻疹等。